有关窝沟封闭正确的观点是
A. 乳磨牙不做窝沟封闭
B. 只需对第一恒磨牙做窝沟封闭
C. 只要有窝沟就可以做窝沟封闭
D. 成年人不需要做窝沟封闭
E. 患有畸形舌尖的前牙不需做窝沟封闭

正确答案：C。只要有窝沟就可以做窝沟封闭

解析：本题考查窝沟封闭。有关窝沟封闭正确的观点是只要有窝沟就可以做窝沟封闭（C对）。窝沟封闭是指不去除牙体组织，在（牙合）面、颊面或舌面的点隙裂沟涂布一层粘结性树脂，保护釉质不受细菌及代谢产物侵蚀，达到预防龋病发生的一种有效防龋方法。窝沟封闭的适用范围广，只要有窝沟就可以做窝沟封闭。第一恒磨牙萌出较早，发生龋坏的几率大，应在儿童6～7岁时就对该牙做窝沟封闭，但并非是只需对第一恒磨牙做窝沟封闭（B错），对于窝沟较深、不易清洁的乳磨牙也应做窝沟封闭（A错）。成年人牙齿发育完成，但对于有深窝沟以及有患龋倾向的恒牙应做窝沟封闭以防止龋病发生，因此成年人也需要做窝沟封闭（D错）。对于有畸形舌尖的前牙来说，两牙尖之间的深沟易存留食物残渣，不易清除，久而久之可形成龋病，因此患有畸形舌尖的前牙也需做窝沟封闭（E错）以消除两尖之间的沟裂，以保护牙体组织及预防病变发生。